关于病因的论述，不正确的是
A. 病因一定在疾病发生之前出现
B. 病因一定与疾病有关联
C. 与疾病有关联的一定是病因
D. 病因与疾病的关系具有可重复性
E. 病因可以影响疾病发生的概率

正确答案：C。与疾病有关联的一定是病因

解析：本题考查病因的相关内容。在多病因学说里，一切可以负面影响健康的因素或事件都可以称为病因，而且无论传染病还是慢性病，其病因都是多重的，病因与疾病之间的关系是复杂的（D对），病因与病因之间也存在复杂的关系。所以病因一定与疾病有关联（B对），但与疾病有关联的不一定是病因（C错，为本题正确答案）。病因一定在疾病发生之前出现（A对），它可以影响疾病发生的概率（E对）。